甲状腺激素对下列哪个器官的发育最为重要
A. 肝和肾
B. 肾和心
C. 骨和脑
D. 肝和脑
E. 心和脑

正确答案：C。骨和脑